属于自身免疫性疾病的是
A. 雪口病
B. 寻常狼疮
C. 带状疱疹
D. 手足口病
E. 寻常型天疱疮

正确答案：E。寻常型天疱疮

解析：本题考查自身免疫性疾病。寻常型天疱疮（E对）属于自身免疫性疾病。天疱疮是一类严重的、慢性的皮肤黏膜自身免疫大疱性疾病，其特征性病变为患者的黏膜上皮（和/或皮肤表皮）棘细胞间存在抗粘接成分的抗原抗体反应，从而导致棘层松解和水疱形成，寻常型天疱疮为其中最常见和严重的分型。雪口病（A错）是由于口腔念珠菌感染引起的口腔黏膜炎症，通常表现为颊黏膜、嘴唇内侧、上腭等部位出现类似凝乳状的白色膜状物。寻常狼疮（B错）是由结核分枝杆菌感染血行播散至皮肤所致的最常见的慢性皮肤结核病，表现为面部、颈部、臀部和四肢等处皮肤的鲜红或红褐色粟粒大小的结节、红褐色浸润性损害及萎缩性瘢痕。带状疱疹（C错）是由水痘-带状疱疹病毒所引起的，以沿单侧周围神经分布的簇集性小水疱为特征，常伴有明显的神经痛。手足口病（D错）是由多种肠道病毒引起的一种儿童传染病，该病以手、足和口腔黏膜疱疹或破溃后形成糜烂或浅溃疡为主要临床特征。